可导致跟腱炎或跟腱断裂的不良反应的是
A. 克林霉素
B. 美罗培南
C. 阿米卡星
D. 头孢哌酮
E. 环丙沙星

正确答案：E。环丙沙星

解析：本题考查环丙沙星的不良反应。氟喹诺酮类抗菌药环丙沙星（E对）可致跟腱炎症和跟腱断裂的不良反应。克林霉素（A错）不良反应是皮肤过敏反应、皮疹、瘙痒；肝脏转氨酶ALT及AST升高等。美罗培南（B错）和头孢哌酮（D错）不良反应是过敏反应，严重肝肾障碍患者慎用。阿米卡星（C错）不良反应是耳毒性和肾毒性。